通常不会引起张口受限的间隙感染是
A. 咬肌间隙感染
B. 翼下颌间隙感染
C. 颞下间隙感染
D. 眶下间隙感染
E. 下颌骨急性化脓性骨髓炎

正确答案：D。眶下间隙感染

解析：本题考查引起张口受限的间隙感染。眶下间隙感染向上向眶内扩散，形成眶内蜂窝织炎，可沿面静脉、内眦静脉、眼静脉向颅内扩散，并发海绵窦血栓性静脉炎（D错，为本题的正确答案）。张口受限，一般由炎症可能波及下颌骨及其内外侧的翼内肌、咬肌等的颌面部感染引起，如咬肌间隙感染（A对）、翼下颌间隙感染（B对）、颞下间隙感染（C对）、化脓性骨髓炎急性期（E对）等。